28岁一男性，自觉前尿道有轻度痒感，排尿微痛，尿道分泌物稀薄、有黏液性或黏脓性，经诊断为非淋菌性尿道炎，可选用的抗菌药物有
A. 多西环素
B. 米诺环素
C. 克林霉素
D. 阿奇霉素
E. 左氧氟沙星

正确答案：A、B、D、E。多西环素；米诺环素；阿奇霉素；左氧氟沙星